与基础代谢率成正比的是
A. 身高
B. 体重
C. 体表面积
D. 心排出量
E. 年龄

正确答案：C。体表面积